男，65岁。间断咳嗽咳痰5年，1周来因发热咳黄痰就诊。曾口服“感冒药”和“祛痰药”无明显效果。查体：T38.5℃，口唇略发绀，双下肺可闻及少量湿啰音。为明确诊断，首选的检查是
A. 血气分析
B. 肺功能
C. 痰培养+药敏
D. 胸部X线片
E. 支气管镜

正确答案：D。胸部X线片

解析：患者为老年男性，间断咳嗽、咳痰5年，1周来因发热咳黄痰（提示存在感染）就诊，曾口服“感冒药”和“祛痰药”无明显效果，发热（肺炎的典型症状），口唇略发绀，双下肺可闻及少量湿啰音，根据其临床表现和体征，可初步诊断为肺炎。为明确诊断，首选的检查是胸部X线（D对）。血气分析（A错）可用于了解体内O₂的供应及酸碱平衡状况，是抢救危重患者和监护的重要指标之一（九版诊断学P546），也可用于哮喘严重程度的判断以及呼吸衰竭的诊断，本病患者只是略有发绀，并未达到危重程度，暂时不需要血气分析。肺功能（B错）常用于测定COPD诊断的主要指标，但是患者本身有明显的感染症状，需用X线片先明确有无肺部感染。痰培养+药敏（C错）是肺炎确诊手段，可以明确引起肺炎的病原体，但是本患者应首先建立肺炎的诊断，然后再确诊病原体，所以不作首选检查。支气管镜（E错）是有创检查，在X线等无创检查无法明确诊断时才应采用，一般不做为首选检查。